患儿，3岁。发热，体温39.8℃，烦躁不安，面红目赤，口渴欲饮，全身丘疹、疱疹、结痂散布，躯干部密集，根盘红晕，疹色紫暗，牙龈肿痛，小便黄，大便干，舌红绛苔黄糙，脉洪数。治疗应首选
A. 银翘散
B. 白虎汤
C. 普济消毒饮
D. 清胃解毒汤
E. 黄连解毒汤

正确答案：D。清胃解毒汤

解析：患儿发热并全身丘疹、疱疹、结痂散布，当属水痘，本患儿气分热盛，致烦躁不安，面红目赤，口渴欲饮小便黄，大便干，毒传营分，与内湿相搏外透肌表，则致全身丘疹、疱疹，疹色紫暗，舌红绛苔黄糙，脉洪数均为邪炽气营之象。治宜清胃解毒汤，可清气凉营，解毒化湿（D对）。银翘散适于邪郁肌表的幼儿急疹、风疹、水痘（A错）。白虎汤阳明气分大热症（B错）。普济消毒饮适于热毒壅盛的流行性腮腺炎即是痄腮（C错）。黄连解毒汤适于热盛三焦症（E错）。